判断药物有效性的指标（临床常见）不包括
A. 疾病治愈率
B. 疾病显效率
C. 病床占用率
D. 临床好转率
E. 临床无效率

正确答案：C。病床占用率